单位用“体积/时间”表示的药动学参数是
A. 消除率
B. 速率常数
C. 生物半衰期
D. 绝对生物利用度
E. 相对生物利用度

正确答案：A。消除率

解析：本题考查清除率。清除率（A对）是单位时间内从体内消除的含药血浆体积，单位用“体积/时间”表示；速率常数（B错）的单位取决于反应的总级数；t1/2为生物半衰期（C错），单位为时间；绝对生物利用度（D错）、相对生物利用度（E错）以百分数表示。